依据《侵权责任法》，医务人员实施手术前应当向患者说明的事项是
A. 医疗纠纷处理方式
B. 隐私保密要求
C. 替代医疗方案
D. 承担赔偿责任的情形
E. 复印病例资料范围

正确答案：C。替代医疗方案

解析：需要实施手术、特殊检查、特殊治疗的，医务人员应当及时向患者说明医疗风险、替代医疗方案（C对）等情况，并取得其书面同意。